适用于“急则治标”治则的是
A. 阴虚咳嗽
B. 持续低热
C. 大小便不通
D. 慢性胃痛
E. 下肢水肿

正确答案：C。大小便不通

解析：大小便不通属于急重症，应当采取急则治标的原则（C对）；其他各项都不表现为急重症（ABDE错）。